有关血清病的正确叙述是
A. 免疫复合物沉积于毛细血管基底膜
B. 补体含量增加
C. ADCC作用破坏靶细胞
D. 症状局限在淋巴结
E. 补体一般不参与致局部病理损伤

正确答案：A。免疫复合物沉积于毛细血管基底膜